肾排镁障碍致高镁血症的常见病因是
A. 急性肾功能衰竭少尿期
B. 严重低渗性脱水
C. 甲状腺功能减退
D. Addison病
E. 以上都是

正确答案：E。以上都是

解析：急性肾功能衰竭少尿期（A对）时肾脏排水减少，伴尿排镁也减少。严重脱水（B对）时循环血量下降，尿量减少，镁排出也减少。甲状腺素能抑制肾小管重吸收镁，甲状腺功能减退（C对），镁重吸收增多致高镁血症。Addison病（D对，故E为本题正确答案）又称原发性慢性肾上腺皮质功能减退症，醛固酮分泌减少，肾排镁作用减弱致高镁血症。